贫铁食品是
A. 蛋类
B. 鱼类
C. 动物内脏
D. 牛奶
E. 肉类

正确答案：D。牛奶